女，68岁。右侧肢体动作迟缓伴震颤7个月。查体：右侧肢体静止性震颤，肌张力齿轮样增高。病变可能的部位是
A. 大脑皮质
B. 脑桥
C. 小脑
D. 内囊
E. 黑质

正确答案：E。黑质

解析：老年女性患者，右侧肢体动作迟缓伴震颤半年（PD表现），查体右侧肢体静止性震颤，肌张力增高（PD体征），故患者考虑诊断为帕金森病，其病变位置为黑质-纹状体多巴胺能神经通路（E对ABCD错）。